某女，30岁。体虚，患经寒痛经，带下清稀。宜选用的中药是
A. 艾叶
B. 蒲黄
C. 槐花
D. 白及
E. 紫珠叶

正确答案：A。艾叶

解析：本题考查艾叶的主治病证。患者宜选用的中药是艾叶（A对）。艾叶【主治病证】（1）虚寒性崩漏下血、胎漏。（2）经寒痛经、月经不调，带下清稀，宫冷不孕。（3）脘腹冷痛。（4）湿疹瘙痒（外用）。此外，可用于温灸。蒲黄（B错）【主治病证】（1）吐血，咳血，衄血，尿血，便血，崩漏，外伤出血。（2）血瘀之心腹疼痛、痛经，产后瘀阻腹痛。（3）血淋涩痛。槐花（C错）【主治病证】（1）血热妄行所致的各种出血证，尤宜便血、痔疮出血。（2）肝火上炎之头痛目赤。白及（D错）【主治病证】（1）咳血，衄血，吐血，外伤出血。（2）疮痈肿毒，烫伤，手足皲裂，肛裂。（3）肺痈而咳吐腥痰脓血日渐减少者。紫珠叶（E错）【主治病证】（1）咳血，衄血，吐血，便血，尿血，崩漏，外伤出血。（2）烧烫伤，疮疡肿毒。